解表药的味多是
A. 辛味
B. 酸味
C. 甘味
D. 苦味
E. 咸味

正确答案：A。辛味

解析：该题考查的是五味理论。辛：“能散、能行”，即具有发散、行气行血的作用，解表药是以发散表邪、治疗表证为主的药物，多辛散轻扬，故解表药味多辛。（A对）。酸：“能收、能涩”，即具有收敛、固涩的作用，收涩药是以治疗各种滑脱病证为主的药物，多酸涩，故收涩药味多酸（B错）。甘：“能补、能和、能缓”，即具有补益、和中调和药性和缓急止痛的作用，补益药多用治正气虚弱等，根据“甘能补”的理论，故补益药一般具有甘味（C错）。苦：“能泄、能燥、能坚”，即具有清热泻火、燥湿、坚阴等作用，清热药、攻下药泻火力强多苦寒，故清热药多味苦（D错）。咸：“能下、能软”即具有泻下通便、软坚散结的作用，泻下或润下药多用于治疗大便燥结、癥瘕痞块等，软坚、消散力强，故泻下以及润下药多味咸（E错）。